有关脊髓丘脑束的描述，错误的是
A. 脊髓丘脑束位于脊髓外侧索和前索
B. 脊髓丘脑束终止于同侧背侧丘脑腹后内侧核
C. 是由经白质前连合交叉而来的纤维束构成
D. 脊髓丘脑束的起始细胞位于对侧脊髓灰质全长，但以颈，腰膨大最集中
E. 无

正确答案：B。脊髓丘脑束终止于同侧背侧丘脑腹后内侧核

解析：脊髓丘脑束分为脊髓丘脑侧束和脊髓丘脑前束，脊髓丘脑侧束位于外侧索的前半部，脊髓丘脑前束位于前索，因此脊髓丘脑束位于脊髓外侧索和前索（A对），脊髓丘脑束主要起自脊髓灰质 I和IV～VIII层，纤维经白质前连合交叉至对侧时上升 1～2 节段（即边交叉边上升），或先上升 1～2 节段后再经白质前连合，交叉至对侧外侧索和前索上行，止于背侧丘脑（B错，为本题正确答案），综上，脊髓丘脑束是由经白质前连合交叉而来的纤维束构成（C对），脊髓丘脑束的起始细胞位于对侧脊髓灰质全长，但以颈，腰膨大最集中（D对）。